下列有关Ⅲ型超敏反应的发生机制说法正确的是
A. 复合物易被单核-吞噬细胞吞噬清除
B. 易通过肾小球基底膜随尿液排出体外
C. 沉积于毛细血管基底膜
D. 血液中的不可溶性抗原与IgM结合可形成中等大小的免疫复合物
E. 血液中的不可溶性抗原与IgG结合可形成中等大小的免疫复合物

正确答案：C。沉积于毛细血管基底膜

解析：Ⅲ型超敏反应的发生机制：血液中的可溶性抗原与IgG或IgM结合可形成中等大小的免疫复合物。该复合物不易被单核-吞噬细胞吞噬清除，也不易通过肾小球基底膜随尿液排出体外，而沉积于毛细血管基底膜。掌握“Ⅱ型、Ⅲ型、Ⅳ型超敏反应”知识点。